男，71岁。间断咳嗽、咳痰20余年，加重伴喘憋1周。近2天出现嗜睡。查体：意识模糊，口唇发绀，球结膜水肿，双肺满布哮鸣音。双下肢水肿。患者经吸氧治疗后呼吸困难进一步加重。血气分析示pH7.10，PaO₂65mmHg，PaCO₂102mmHg，查体：昏睡，口唇发绀，双肺散在干湿性啰音。此时，应首选的治疗措施是
A. 糖皮质激素静脉滴注
B. 大剂量利尿剂静脉滴注
C. 呼吸兴奋剂静脉滴注
D. 静脉应用广谱抗生素
E. 机械通气

正确答案：E。机械通气

解析：71岁老年男性患者，间断咳嗽、咳痰20余年，加重伴喘憋1周。近2天出现嗜睡（慢阻肺病史，急性加重期，意识差）。查体：意识模糊（肺性脑病表现），口唇发绀，球结膜水肿，双肺满布哮鸣（呼吸衰竭）。双下肢水肿（心衰表现）。患者经吸氧治疗后呼吸困难进一步加重（普通吸氧无明显改善）。血气分析示pH7.10（正常值7.35～7.45），PaO₂65mmHg（正常值80～100mmHg），PaCO₂102mmHg（正常值40mmHg）。查体：昏睡，口唇发绀，双肺散在干湿性啰音。考虑患者为肺性脑病，Ⅱ型呼吸衰竭，代谢性酸中毒合并呼吸性酸中毒。患者情况严重，已出现意识障碍，符合机械通气（E对）的指征。肺性脑病一般不适用糖皮质激素静脉滴注（A错）。呼衰在合并心衰时，一线治疗为控制感染，改善通气，心衰一般能得到改善；若仍有水肿、少尿，可适当使用利尿剂以消除水肿，减少右心前负荷。大剂量利尿剂静脉滴注（B错）会导致有效血容量减少，可能加重组织缺氧，且使痰液粘稠，不易排出。肺源性心脏病应慎用呼吸兴奋剂静脉滴注（C错），呼吸兴奋剂适用于呼吸中枢受抑制和呼吸肌疲劳引起的呼吸衰竭。当病人呼吸困难加重，咳嗽伴痰量增加、有脓性痰时，应依据病人所在地常见病原菌及其药物敏感情况积极选用抗生素治疗，故不选静脉应用广谱抗生素（D错），且该患者已出现严重呼吸衰竭、心力衰竭、肺性脑病表现，当务之急是改善通气。